主穴外，还应加
A. 心俞、厥阴俞、脾俞
B. 心俞、肾俞、太溪、足三里
C. 心俞、胆俞、大陵、丘墟
D. 肝俞、间使、太冲
E. 脾俞、胃俞、足三里

正确答案：C。心俞、胆俞、大陵、丘墟

解析：题中患者失眠2年，经常多梦少寐，可诊断为不寐；入睡迟、易惊醒、加之平常遇事惊怕、多疑善感、气短头晕，舌淡、脉弦细，可辨证为心胆气虚之不寐。心俞、厥阴俞、脾俞合用可用于心脾两虚之不寐（A错）。心俞、肾俞、太溪、足三里配合用于心肾不交之不寐（B错）。题中患者辨为心胆气虚之不寐，心俞为心之背俞穴，胆俞为胆之背俞穴，大陵为心包经原穴，丘墟为胆经原穴，四穴合用，可安神定惊（C对）。肝俞、间使、太冲可用于癫狂痫、中风等肝经风热疾患（D错）。脾俞、胃俞、足三里配合可用于脾胃不和之不寐（E错）。